低容量性高钠血症早期
A. 尿量减少，尿钠含量降低
B. 尿量减少，尿钠含量增加
C. 尿量不少，尿钠含量降低
D. 尿量增多，尿钠含量降低
E. 尿量增多，尿钠含量增加

正确答案：B。尿量减少，尿钠含量增加

解析：高渗性脱水时细胞外液渗透压增高引起ADH分泌增加，尿量减少同时引起尿钠含量增加（B对）。尿量增多，尿钠含量降低（D错）见于肾外原因引起的低容量性低钠血症。